治疗外感风热，发热，微恶寒，头痛，咽喉肿痛，兼胸闷胁肋胀痛，应首选
A. 升麻
B. 薄荷
C. 葛根
D. 蝉蜕
E. 牛蒡子

正确答案：B。薄荷

解析：该题考查薄荷的功效，属记忆内容。薄荷功效 疏散风热，清利头目，利咽透疹，疏肝行气（B对）。